必须经过指定药品检验机构检验属于
A. 注册检验
B. 监督抽检
C. 指定检验
D. 复验

正确答案：C。指定检验

解析：本题考查药品质量监督检验的类型。每批上市销售前须经指定的批签发机构进行审核、检验的活动，属于指定检验（C对）。指定检验：是指国家法律或国家药品监督管理部门规定某些药品在销售前或者进口时，必须经过指定药品检验机构检验，检验合格的，才准予销售的强制性药品检验。根据《药品质量抽查检验管理办法》（国药监药管〔2019〕34号），药品质量抽查检验根据监管目的一般可分为监督抽检（B错）和评价抽检。监督抽检是指药品监督管理部门根据监管需要对质量可疑药品进行的抽查检验，评价抽检是指药品监督管理部门为评价某类或一定区域药品质量状况而开展的抽查检验。注册检验（A错）：药品注册检验，包括标准复核和样品检验。新药上市申请、首次申请上市仿制药、首次申请上市境外生产药品，应当进行样品检验和标准复核。复验（D错）：当事人对药品检验结果有异议的，可以自收到药品检验结果之日起七日内向原药品检验机构或者上一级药品监督管理部门设置或者指定的药品检验机构申请复验，也可以直接向国务院药品监督管理部门设置或者指定的药品检验机构申请复验。受理复验的药品检验机构应当在国务院药品监督管理部门规定的时间内作出复验结论。